主要以药物原形自肾排泄
A. 地西泮
B. 苯巴比妥
C. 西地兰
D. 三唑仑
E. 水合氯醛

正确答案：B。苯巴比妥